室间隔缺损伴艾森曼格综合征的临床表现为
A. 全身性青紫
B. 暂时性青紫
C. 持续性青紫
D. 不出现青紫
E. 差异性青紫

正确答案：C。持续性青紫

解析：室缺本身对左向右分流量不构成阻力，血液在两心室自由交通，即非限制性室间隔缺损。大量左向右分流量使肺循环血流量增加，当超过肺血管床的容量限度时，出现容量性肺动脉高压，肺小动脉痉挛，肺小动脉中层和内膜层渐増厚，管腔变小、梗阻。随着肺血管病变进行性发展则渐变为不可逆的阻力性肺动脉高压。当右心室收缩压超过左心室收缩压时，左向右分流逆转为双向分流或右向左分流，出现发绀，即艾森门格综合征。室缺一般在婴幼儿期及儿童早期多不出现青紫，只表现为活动耐力下降，至青春期前青紫出现，以后持续青紫并且逐渐加重（C对）。差异性青紫常见于动脉导管未闭（E错）。